胰头的描述，何者错误
A. 位于第二腰椎右侧
B. 其上方、下方、右侧被十二指肠包绕
C. 其后方有门静脉通过
D. 其下部有突向左后上方的钩突
E. 右前方与十二指肠降部间有胆总管

正确答案：C。其后方有门静脉通过

解析：胰头位于第二腰椎体右侧(A对)，其上下方和右侧被十二指肠包绕(B对)，其下方与钩突之间有门静脉起始部(C错，为本题正确答案)，胰头下方有突向左后上方的钩突(D对)，在右前方与十二指肠降部间常有胆总管经过(E对)。